咽部手术及结扎舌动脉的重要解剖标志是
A. 舌骨体
B. 舌骨大角
C. 舌骨小角
D. 下颌骨
E. 甲状软骨

正确答案：B。舌骨大角

解析：临床上舌骨大角是咽部手术以及寻找或结扎舌动脉的重要解剖标志。掌握“蝶骨、颞骨及舌骨的解剖特点”知识点。